子宫内膜异位症的临床特点是
A. 痛经程度与病变范围成正比
B. 继发性痛经，进行性加重
C. 均存在卵巢囊肿内陈旧性出血
D. 15%～30%患者月经正常
E. 雌激素治疗有利于改善症状

正确答案：B。继发性痛经，进行性加重

解析：子宫内膜组织出现在子宫体以外的部位时，称为子宫内膜异位症。异位内膜可侵犯全身任何部位，卵巢最易被异位内膜侵犯，其内可有陈旧性出血性液体，但并非所有子宫内膜异位症均存在卵巢囊肿内陈旧性出血（C错）。子宫内膜异位症临床表现最常见为继发性痛经，进行性加重（B对），痛经程度与病变范围不一定成正比（A错），黏连严重的卵巢异位囊肿患者可能并无疼痛，而盆腔内小的散在病灶却可引起难以忍受的疼痛。约有15%～30%患者有经量增多，经期延长等月经异常的表现（D错）。子宫内膜异位症是激素依赖性疾病，其治疗原则为抑制雌激素合成（E错）使异位内膜萎缩雌激素。